根据《麻醉药品和精神药品管理条例》《麻醉药品和精神药品管理办法（试行）》，关于加强麻醉药品和精神药品经营管理的说法，错误的是
A. 实行统一进货，统一配送，统一管理的药品零售连锁企业可以从事部分第一类精神药品的零售业务
B. 各级药品监督管理部门应当及时将批准的全国性药品批发企业、区域性批发企业、专门从事第二类精神药品批发的企业的名单在网上公布
C. 区域性批发企业之间因医疗急需、运输困难等特殊情况，可以调剂麻醉药品、第一类精神药品，调剂后2日内将调剂情况分别报所在地省级药品监督管理部门备案
D. 区域性批发企业在确保责任区内医疗机构供药的基础上，可以在本省行政区域内向其他医疗机构销售麻醉药品和第一类精神药品

正确答案：A。实行统一进货，统一配送，统一管理的药品零售连锁企业可以从事部分第一类精神药品的零售业务

解析：本题考查麻醉药品和精神药品管理条例。第三十一条经所在地设区的市级药品监督管理部门批准，实行统一进货、统一配送、统一管理的药品零售连锁企业可以从事第二类精神药品零售业务（A错，为本题正确答案）。各级药品监督管理部门应当及时将批准的全国性批发企业、区域性批发企业、专门从事第二类精神药品批发的企业和从事第二类精神药品零售的连锁企业（含相应门店）的名单在网上公布（B对）。区域性批发企业之间因医疗急需、运输困难等特殊情况需要调剂麻醉药品和第一类精神药品的，应当在调剂后2日内将调剂情况分别报所在地省（区、市）药品监督管理部门备案（C对）。区域性批发企业在确保责任区内医疗机构供药的基础上，可以在本省行政区域内向其他医疗机构销售麻醉药品和第一类精神药品（D对）。